上颌后牙远中颈部龋按Black分类应是
A. Ⅰ类洞
B. Ⅱ类洞
C. Ⅳ类洞
D. Ⅴ类洞

正确答案：B。Ⅱ类洞

解析：本题考查Black分类法。上颌后牙远中颈部龋按Black分类应是Ⅱ类洞（B对）。上颌后牙远中颈部龋属于后牙邻面龋。Ⅰ类洞：所有牙面发育点隙裂沟的龋损所备成的窝洞（A错）。Ⅱ类洞：后牙邻面的龋损所备的窝洞，其中包括磨牙及前磨牙的邻面洞。Ⅲ类洞：前牙邻面未累及切角的龋损所备成的窝洞。Ⅳ类洞：前牙邻面累及切角的龋损所备成的窝洞（C错）。Ⅴ类洞：所有牙齿颊（唇）舌面颈1/3处的龋损所备成的窝洞（D错）。